精阜中央的小凹陷是
A. 前列腺囊
B. 前列腺小囊
C. 前列腺底
D. 前列腺尖
E. 前列腺体

正确答案：B。前列腺小囊

解析：前列腺小囊（B对）为精阜中央的小凹陷。